64岁，2周前无明显诱因出现咳嗽，咳黄白痰带血丝，经抗生素治疗效果不佳。体检：体温37.8℃，血压正常，右上肺呼吸音稍弱伴少许湿啰音。血象WBC12×10⁹/L，N0.83。如果该患右侧胸腔出现中等量积液，其原因最可能是
A. 结核性胸膜炎
B. 肺脓肿合并胸腔积液
C. 肺癌胸膜转移
D. 肺梗死合并胸腔积液
E. 肺炎合并胸腔积液

正确答案：C。肺癌胸膜转移

解析：患者老年男性（为肺癌的好发年龄），无明显诱因出现咳嗽，咳黄白痰带血丝，血象稍高，但患者经抗生素治疗效果不佳（抗生素对肺癌无效），提示支气管肺癌（中老年为支气管肺癌的好发年龄，在应用抗生素后，咳嗽咳痰症状没有好转，首先考虑支气管肺癌），当肺癌患者胸腔出现中等量积液时，通常提示肺癌胸膜转移（C对）。结核性胸膜炎（P118）（A错）多见于青年人，有结核病的一般性全身症状，如乏力、盗汗、午后潮热等，呼吸困难是最常见的症状，多伴有胸痛，咳嗽轻微，与该患者不符。肺脓肿合并胸腔积液（B错）、肺炎合并胸腔积液（E错）抗生素治疗均有效。肺梗死合并胸腔积液（D错）常有不明原因的呼吸困难及气促，尤以活动后明显，有胸痛、晕厥、咯血等症状，与该患者不符。